在指导合理用药时，应交代服药后限制饮水的药物是
A. 辛伐他汀
B. 双磷酸盐
C. 苯妥英钠
D. 硫酸亚铁
E. 硫糖铝

正确答案：E。硫糖铝

解析：本题考查限制饮水的药物。硫糖铝（E对）服药后在胃中形成保护膜，服药后1小时内尽量不要喝水，避免保护层被水冲掉。胆固醇主要在夜间合成，故辛伐他汀（A错）宜在睡前服用。双膦酸盐（B错）服用后需多饮水。苯妥英钠（C错）、硫酸亚铁（D错）宜在餐后服用。